乌梅的主治病是
A. 外感咳嗽
B. 湿热泻痢
C. 瘀阻出血
D. 蛔厥腹痛
E. 积滞腹痛

正确答案：D。蛔厥腹痛

解析：本题考查的是乌梅的主治病证。乌梅的主治病是蛔厥腹痛（D对）。乌梅：【主治病证】（1）肺虚久咳。（2）久泻久痢。（3）虚热消渴。（4）蛔厥腹痛。（5）崩漏，便血。紫菀：【主治病证】（1）外感咳嗽（A错）、咳痰不爽。（2）肺虚久咳、痰中带血。椿皮：【主治病证】（1）久泻久痢，湿热泻痢（B错），便血。（2）崩漏，赤白带下。（3）蛔虫病。（4）疮癣作痒。茜草：【主治病证】（1）吐血，衄血，崩漏，尿血，便血等。（2）闭经，痛经，跌打肿痛，痹证关节痛。茜草性寒，化瘀止血多炒炭用，瘀阻出血（C错）兼热者用之为宜；生用则凉血活血通经，瘀血夹热者宜用，又治关节痹痛。莪术：【主治病证】（1）闭经腹痛，癥瘕积聚，胸痹心痛。（2）积滞不化，脘腹胀痛（E错）。